男，28岁。因头疼3个月，加重伴呕吐、间断抽搐、视物模糊1个月就诊。近2年来，喜食生肉。眼底检查发现视神经乳头水肿。最可能的诊断是
A. 脑囊尾蚴病
B. 结核性脑膜炎
C. 隐球菌性脑膜炎
D. 脑肿瘤
E. 病毒性脑炎

正确答案：A。脑囊尾蚴病

解析：患者头疼、呕吐、间断抽搐（脑囊尾蚴病皮质型的典型表现），喜食生肉，眼底水肿（颅内压升高），最可能的诊断是脑囊尾蚴病（A对）。结核性脑膜炎（B错）起病缓慢，多于1～2周非特异性感染症状后，出现脑膜刺激征。隐球菌性脑膜炎（C错）首发症状常为间歇性头痛、恶心及呕吐，伴低热、周身不适、精神不振等非特异性症状。随病情发展，头痛渐加重转为持续性、精神异常、躁动不安，严重者出现不同程度意识障碍，脑膜刺激征为早期最常见阳性体征。脑肿瘤（D错）常无喜食生肉史。病毒性脑炎（E错）病程大多在1～2周。